女性，30岁，背部肿块，红、肿、疼痛3天，寒战、发热39℃，查体：背部肿物3cm×5cm，触之有波动感。当对病灶做局部引流和全身应用抗生素后，仍有寒战、高热，最合适的治疗措施是
A. 联合应用抗生素，并加大剂量
B. 尽快明确细菌种类和药敏试验
C. 寻找有无其他感染病灶
D. 使用抗霉菌药物治疗
E. 加用肾上腺皮质激素

正确答案：C。寻找有无其他感染病灶

解析：根据描述此患者临床表现属于急性蜂窝织炎，在局部处理和全身应用抗生素后仍然有感染症状，则需要寻找有无原发灶或者其他部位的脓肿。掌握“外科感染”知识点。